“通因通用”适用于治疗的病症是
A. 实证
B. 虚证
C. 虚实错杂证
D. 真虚假实证
E. 真实假虚证

正确答案：E。真实假虚证

解析：“通因通用”即以通治通，是指用通利的药物来治疗具有通泻症状的实证。适用于因实邪内阻出现通泄症状的真实假虚证（E对）。实证遵循实则泻之（A错）的原则治疗。虚证遵循虚者补之（B错）的治法治疗。而虚实错杂证一般遵循攻补兼施的原则治疗（C错）。真虚假实证采用塞因塞用（D错）的治法治疗。